下列有关急性化脓性腮腺炎预防方法中，没有的一项内容为
A. 加强营养
B. 加强口腔卫生
C. 保持体液平衡
D. 服用大量抗生素
E. 使用氯己定溶液清洗口腔

正确答案：D。服用大量抗生素

解析：急性化脓性腮腺炎预防：本病主要系脱水及逆行感染所致。故对接受腹部大手术及患严重全身性疾病的患者，应加强护理，保持体液平衡，加强营养及抗感染，同时应加强口腔卫生，食后漱口、刷牙，并可用过氧化氢液或氯己定溶液清洗口腔。掌握“急性化脓性腮腺炎”知识点。